发热伴出血疹可见于以下疾病，除了
A. 伤寒
B. 斑疹伤寒
C. 流行性脑脊髓膜炎
D. 麻疹
E. 败血症

正确答案：A。伤寒

解析：出血疹（P11）亦称瘀点，多见于肾综合征出血热、登革热和流行性脑脊髓膜炎等传染病。伤寒（A错，为本题正确答案）玫瑰疹大多是压之可退色的充血疹，斑疹伤寒（B对）、流行性脑脊髓膜炎（C对）、麻疹（D对）、败血症（E对）等几项后期都是不退色的出血疹。但是玫瑰疹（P150）有时可变成压之不褪色的小出血点，此处须注意与出血疹鉴别。